患儿1岁，间断高热一周，眼结膜充血，口唇皲裂伴出血，草莓舌，肛周皮肤发红，血常规提示白细胞及中性粒细胞增多，血沉增快，诊断为川崎病，以下哪项表现不可能出现在该患儿症状中
A. 胆囊炎
B. 无菌性脑膜炎
C. 颈部淋巴结肿大
D. 腹痛、呕吐及腹泻
E. 肝大

正确答案：A。胆囊炎

解析：川崎病患儿除典型的临床表现外，还可有急性期易激惹、烦躁不安、少数有无菌性脑膜炎的表现。其他表现有腹痛、呕吐、腹泻、麻痹性肠梗阻、肝大、黄疸、血清转氨酶升高、咳嗽、关节痛或关节炎、心包炎、心肌炎、心内膜炎、心律失常，甚至心肌梗死等。掌握“川崎病”知识点。